慢性汞中毒最早出现
A. 肾功能障碍
B. 发热、乏力
C. 贫血
D. 腕下垂
E. 神经衰弱综合征

正确答案：E。神经衰弱综合征